患儿，10个月。腹泻3天，鼻塞流涕，每日大便10余次，呈稀水样，臭味不甚，尿黄；查体：体温38℃，皮肤弹性尚好，前囟平，哭时有泪，听诊心肺正常，肠鸣音亢进，舌苔薄白，指纹红，达于风关；大便镜检无异常。应首先考虑的是
A. 细菌性肠炎风寒证
B. 细菌性肠炎湿热证
C. 病毒性肠炎风寒证
D. 病毒性肠炎湿热证
E. 霉菌性肠炎风寒证

正确答案：C。病毒性肠炎风寒证

解析：腹泻3天（腹泻的病因主要有感染性和非感染性两大类，而以感染性多见）。体温38℃，鼻塞流涕（上呼吸道感染症状），每日大便10余次，呈稀水样，臭味不甚，尿黄（轮状病毒肠炎的大便次数多，量多，水分多，黄色水样便或蛋花样便带少量黏液，无腥臭味），查体：皮肤弹性尚好，前囟平，哭时有泪（尚无脱水症状，为轻型腹泻），听诊心肺正常，肠鸣音亢进（考虑肠管炎症），舌苔薄白，指纹红，达于风关（病情较轻是外感病初起）。大便镜检无异常（C对）。细菌性肠炎可作呕吐物及大便培养，获得病原菌即可确诊（A错）。湿热泻证候：大便水样，或如蛋花汤样，泻下急迫，量多次频，气味秽臭，或泻下不爽，腹痛时作，食欲不振，或伴呕恶，神疲乏力，或发热烦闹，口渴，小便短黄，舌质红，苔黄腻，脉滑数，指纹紫。治法：清肠解热，化湿止泻。方药：葛根黄芩黄连汤加减（BD错）。霉菌性肠炎多发于营养不良或长期应用广谱抗生素的小儿，大便次数增多，每日3～5次，少数可达10次，为黄色稀便，泡沫较多，带有粘液，有时可见豆腐渣样细块，大便镜检可见真菌抱子和菌丝，粪便培养可有真菌生长（E错）。